药物性牙龈增生的临床表现
A. 波及全口牙，以上下前牙区较重
B. 增生范围可由边缘龈到附着龈
C. 龈质地坚韧有弹性
D. 牙龈呈球形，结状性增生
E. 以上都是

正确答案：E。以上都是

解析：本题考查药物性牙龈肥大的临床表现。药物性牙龈增生（肥大）是指长期服用某些药物而引起牙龈的纤维性增生和体积增大。增生的牙龈波及全口牙，以上下前牙区较重（A对），增生起始于唇颊侧或舌腭侧龈乳头，牙龈呈球形，结状性增生（D对）。增生范围可由边缘龈到附着龈（B对），累及范围较大。牙龈呈纤维性增生，质地坚韧有弹性（C对），一般不易出血。（ABCD均对，故E为本题的正确答案）。